寒邪致病，多见疼痛症状的主要原因是
A. 寒客肌表，卫阳被郁不得宣泄而疼痛
B. 寒性凝滞，气血阻滞而疼痛
C. 寒主收引，经脉拘急而疼痛
D. 寒为阴邪，易伤阳气，阳虚不能温煦故疼痛
E. 寒性收引，气机收敛，故疼痛

正确答案：B。寒性凝滞，气血阻滞而疼痛

解析：寒性凝带主痛，凝滞，即凝结阻滞，凝滞，指寒邪伤人，易使气血津液凝结脉阻滞人身气血液之所以畅行不息，全赖一身阳气的温煦推动。一旦阴寒之邪侵犯，阳气受损，失其温煦，易使经脉气血运行不畅，甚或凝结阻滞不通，不通则痛（B对）。感受寒邪，最易损伤人体阳气，如外寒侵袭肌，卫阳被遏，可见恶寒发热，无汗，鼻塞喷嚏等症（A错）；寒邪直中脾胃，脾阳受损，可见院腹冷痛，呕吐泄泻等症；寒邪直中于少阴，损伤心肾阳，则可见恶寒踡卧，手足厥冷，下利清谷，小便清长，精神萎靡，脉微细等症（D错）。《素问·举痛论》说：“寒则气收”“寒性收引”，指寒邪侵袭人体，可使气机收敛，腠理、经络、筋脉收缩而挛急（CE错）。